男性，24岁，头部被木棒击伤昏迷半小时后转醒，左颞骨线性骨折，3小时后转入昏迷状态，出现瞳孔散大，应诊断为
A. 脑震荡
B. 脑挫伤
C. 原发性脑干损伤
D. 硬膜外血肿
E. 继发性脑干损伤

正确答案：D。硬膜外血肿

解析：本题脑外伤患者先昏迷再清醒再昏迷，左颞骨线性骨折加上瞳孔散大，为硬膜外血肿（D对）。脑震荡伤后昏迷时间多在30分钟以内，有明显的近事遗忘症，且无定位症状及脑内器质性损害；脑脊液检查多无异常（A错）。脑挫裂伤：伤后昏迷在半小时以上，并即刻出现局灶症状与体征，脑脊液呈血性改变，神经系统检查多有阳性体征，CT检查可见脑挫伤区有点片状高密度或高低混杂密度影像（B错）。原发性脑干损伤：伤后即刻出现显著的生命功能紊乱，眼球固定、瞳孔多变，高热不退，昏迷深且持久，但不伴有颅内压增高表现；若为中脑损伤则出现去大脑强直，表现为两上肢伸直、内收并内旋，两下肢挺直，头后仰，呈角弓反张状（C错）。继发性脑干损伤症状是：1.头痛、呕吐、烦躁：外伤之后出现剧烈头痛、频繁呕吐和不能解释的烦躁时，都应考虑到有急性脑受压的可能。2.瞳孔大小、对光反射：仔细观察瞳孔可以见到早期伤侧的瞳孔稍有缩小，以后开始扩大，表现为双侧瞳孔不等大，最后是双侧瞳孔均扩大；对光反射开始是迟钝以后则消失（E错）。